一患者来医院就诊，由于该患者病情危重，需要配置医院没有的药物进行治疗。该医院需要向哪个部门申请
A. 省卫健委
B. 市医学会
C. 市卫健委
D. 省医学会
E. 省级药品监督管理局

正确答案：E。省级药品监督管理局

解析：申请配制医疗机构制剂，申请人应当填写《医疗机构制剂注册申请表》，向所在地省级药品监督管理部门或者其委托的设区的市级食品药品监督管理机构提出申请，报送有关资料和制剂实样（E对）。